光化学烟雾是由下列哪些环境污染物在强烈的太阳紫外线作用下，发生光化学反应而形成的一种浅蓝色烟雾
A. H₂S、CO
B. CO₂、NOX
C. NOX、烃类
D. 烃类、醛类
E. 醛类、酮类

正确答案：C。NOX、烃类

解析：光化学烟雾是汽车尾气中的NOX和烃类在阳光照射下形成的二次污染物（C对）。H2S、CO、烃类造成的是一般性的空气污染（AD错）。CO₂是造成温室效应的温室气体（B错）。醛类和酮类是浅蓝色烟雾的主要成分（E错）。